女，2岁。发热3天，体温39℃，流涕，咳嗽。皮肤出现红色斑丘疹，体温升至40℃。颊黏膜粗糙，可见白色斑点。最可能的诊断是
A. 麻疹
B. 风疹
C. 水痘
D. 猩红热
E. 肺炎

正确答案：A。麻疹

解析：麻疹是由麻疹病毒引起的传染性呼吸道疾病。可表现呼吸道卡他炎症，发热第2～3天口腔麻疹黏膜斑；皮疹特点为红色斑丘疹，退疹后有色素沉着及细小脱屑；发热3～4天后出疹，出疹期为发热高峰。患儿高热、流涕，皮肤出现红色斑丘疹，出疹时体温升高，且出现白色的麻疹黏膜斑，为典型的麻疹（A对）。